注射用头孢曲松钠与含钙类溶液合并用有可能导致致死性结局不良反应。注射用头孢曲松钠说明书中应注明
A. “在药师指导下购买和使用”
B. 黑体字警示语
C. “免费”
D. “不推荐在该疾病流行季节使用”

正确答案：B。黑体字警示语

解析：本题考查药品说明书的“警示语”。注射用头孢曲松钠与含钙类溶液合并用有可能导致致死性结局不良反应。注射用头孢曲松钠说明书中应注明黑体字警示语（B对）。“警示语”是指对药品严重不良反应及其潜在的安全性问题的警告，还可以包括药品禁忌、注意事项及剂量过量等需提示用药人群特别注意的事项。有该方面内容的，应当在说明书标题下以醒目的黑体字注明。无该方面内容的，不列该项。含有化学药品（维生素类除外）的中药复方制剂，应注明本品含××（化学药品通用名称）。处方药必须标注：“请仔细阅读说明书并在医师指导下使用”（A错），并印制在说明书标题下方。疫苗的包装标识：《条例》第13条规定，疫苗生产企业应当在其供应的纳入国家免疫规划疫苗的最小外包装的显著位置，标明“免费”字样（C错）以及国务院卫生主管部门规定的“免疫规划”专用标识。具体管理办法由国务院药品监督管理部门会同国务院卫生主管部门制定。减毒活疫苗还需在该项下注明：本品为减毒活疫苗，不推荐在该疾病流行季节使用（D错）。